下列哪一种物质的合成过程仅在肝脏中进行
A. 尿素
B. 糖原
C. 血浆蛋白
D. 脂肪酸
E. 胆固醇

正确答案：A。尿素

解析：尿素：是人体的氨在肝内通过鸟氨酸循环合成的，是氨分解代谢的终产物。掌握“氨基酸及氨的代谢”知识点。